依据《中华人民共和国药品管理法实施条例》的规定，不得在其包装、标签、说明书及有关宣传资料上进行含有预防、治疗、诊断人体疾病等有关内容的宣传的是
A. 中药材品种
B. 预防性生物制品
C. 非药品
D. 中药饮片
E. 血液制品

正确答案：C。非药品

解析：本题考查药品管理。《中华人民共和国药品管理法实施条例》规定，非药品不得在不得在其包装、标签、说明书及有关宣传资料上进行含有预防、治疗、诊断人体疾病等有关内容的宣传（C对）。